绝大多数血浆蛋白质的合成场所是
A. 肾脏
B. 骨髓
C. 肝脏
D. 肌肉
E. 脾脏

正确答案：C。肝脏

解析：绝大多数血浆蛋白质在肝合成，还有少量的蛋白质是由其他组织细胞合成的，如γ-球蛋白是由浆细胞合成的。掌握“血液成分及血浆蛋白”知识点。